甲氧苄啶和磺胺甲噁唑联合应用的目的有
A. 减少代谢
B. 减少排泄
C. 协同抗菌
D. 防止发生叶酸缺乏症
E. 防止产生耐药菌株

正确答案：A、C、E。减少代谢；协同抗菌；防止产生耐药菌株

解析：本题考查药物的联合应用。甲氧苄啶和磺胺甲噁唑联合应用的目的有减少代谢（A对）、协同抗菌（C对）、防止产生耐药菌株（E对）。磺胺甲噁唑（SMZ）和甲氧苄啶（TMP）联合应用可发挥协同抗菌作用。甲氧苄啶可选择性抑制细菌二氢叶酸还原酶的活性，从而抑制细菌的生长繁殖。磺胺甲噁唑与甲氧苄啶联合后，SMZ作用于二氢叶酸合成酶，干扰合成叶酸的第一步，而TMP作用于叶酸合成代谢的第二步，选择性抑制二氢叶酸还原酶的作用，因此可使细菌的叶酸代谢受到双重阻断，减少耐药菌株的产生。还可竞争性抑制磺胺甲噁唑的肾小管分泌，减少代谢，增强药效。